毒力质粒是
A. F因子
B. R质粒
C. Vi质粒
D. Col质粒
E. r决定因子

正确答案：C。Vi质粒

解析：毒力质粒（Vi质粒,编码与该菌致病性有关的毒力因子），如致病性的大肠埃希菌产生的耐热性肠毒素是由ST质粒编码的；细菌粘附定植在肠粘膜表面是由K质粒决定的。掌握“细菌遗传变异的物质基础及机制”知识点。